男，8岁。右足底被铁锈钉刺伤12天，出现张口困难，继之出现苦笑面容，角弓反张，声响及触碰病人可诱发上述症状，神志清楚，无发热。这种菌感染发病率约占污染者的百分比（%）
A. 0.1～0.2
B. 0.3～0.4
C. 0.5～0.6
D. 0.7～0.8
E. 1.0～2.0

正确答案：E。1.0～2.0

解析：患者右足底被铁锈钉刺伤（深部创伤），后出现张口困难，苦笑面容，角弓反张，声响及触碰病人可诱发上述症状，应诊断为破伤风（破伤风是是常和创伤相关联的一种特异型感染。其典型表现为张口困难、哭笑面容、角弓反张等肌肉痉挛症状，可因轻微的刺激，如光、声、接触、饮水等诱发）。创伤后破伤风梭菌的污染率很高，可以达到25%～80%，但其发病机制有赖于伤处的条件，尤其是缺氧环境，故其发病率较低，仅占污染者的1%～2%（E对）。而现在的观点（九版外科学）认为：破伤风发病率只占污染者的10％～20％。